有机磷农药中毒的主要机制为
A. 抑制胆碱酯酶活性
B. 抑制己糖激酶活性
C. 抑制琥珀酸脱氢酶活性
D. 抑制枸橼酸合成酶活性
E. 抑制异枸橼酸脱氢酶活性

正确答案：A。抑制胆碱酯酶活性

解析：本题考查有机磷农药中毒的主要机制。有机磷农药是一类具有抑制胆碱酯酶活性、化学结构相似的有机化合物。该类农药中毒的主要机制为抑制胆碱酯酶的活性（A对BCDE错）。